治疗气郁型崩漏，宜配用
A. 中极、血海
B. 膈俞、血海
C. 中极、阴陵泉
D. 阴陵泉、太冲
E. 膻中、太冲

正确答案：E。膻中、太冲

解析：气郁型崩漏多因暴怒伤肝，气血乱动，血液妄行所致，治宜疏肝解郁、固崩止漏。太冲穴为肝经原穴和输穴，可疏肝理气、调节气血；膻中为心包之募穴、八会穴之气会，可条畅气机；故治疗气郁型崩漏宜配用膻中、太冲（E对）。